含有毒蛋白，对胃肠黏膜有刺激和腐蚀作用的中药是
A. 巴豆
B. 苍耳子
C. 苦杏仁
D. 蓖麻子
E. 牛蒡子

正确答案：A、B、D。巴豆；苍耳子；蓖麻子

解析：本题考查炮制对含蛋白质、氨基酸类药物的影响。含有毒蛋白，对胃肠黏膜有刺激和腐蚀作用的中药是巴豆（A对）、苍耳子（B对）、蓖麻子（D对）。一些含有毒性蛋白质的药物可通过加热处理，使毒性蛋白变性而降低或消除毒性，如苍耳子、巴豆、白扁豆、蓖麻子等含有毒蛋白，通过加热炮制后可达到降低毒性的目的。某些含苷类有效成分的药物，如黄芩、苦杏仁（C错）经沸水制后，可破坏或降低酶的活性，避免苷类成分被分解而影响疗效。加热可使蛋白质凝固变性，且大多数氨基酸遇热不稳定。因此某些富含蛋白质、氨基酸类成分的药材以生用为宜，如天花粉、雷丸等。牛蒡子（E错）【炮制作用】牛蒡子味辛、苦，性寒。归肺、胃经。具有疏散风热，宣肺透疹，解毒利咽的功能。用于风热感冒，咳嗽痰多，麻疹，风疹，咽喉肿痛，痄腮，丹毒，痈肿疮毒。①生品长于疏散风热，解毒散结。可用于风温初起，痄腮肿痛，痈毒疮疡。②炒牛蒡子能缓和寒滑之性，以免伤中，并且气香，宣散作用更强，长于解毒透疹，利咽散结，化痰止咳。用于麻疹不透，咽喉肿痛，风热咳喘。炒后还可杀酶保苷，利于煎出。随着炒制温度的升高和炒制时间的延长，牛蒡苷的含量下降，牛蒡苷元的含量增加。